治疗着痹宜选用的方药是
A. 左归丸加减
B. 防风汤加减
C. 薏苡仁汤加减
D. 养血荣筋丸加减
E. 舒筋活血丸加减

正确答案：C。薏苡仁汤加减

解析：本题考查的是痹症的辨证论治。治疗着痹宜选用的方药是薏苡仁汤加减（C对）。痹证是由于风、寒、湿、热等邪气闭阻经络，影响气血运行，导致肢体筋骨、关节、肌肉等处发生疼痛、重着、酸楚、麻木，或关节屈伸不利、僵硬、肿大、变形等症状的疾病。（一）行痹：【方剂应用】基础方剂为防风汤（防风、当归、茯苓、杏仁、黄芩、秦艽、葛根、麻黄、桂枝、生姜、甘草、大枣）加减（B错）。（二）痛痹：【方剂应用】基础方剂为乌头汤（川乌、芍药、麻黄、黄芪、甘草）加减。（三）着痹：【方剂应用】基础方剂为薏苡仁汤（薏苡仁、当归、川芎、麻黄、桂枝、羌活、独活、防风、川乌、苍术、甘草、生姜）加减。（四）尪痹：【方剂应用】基础方剂为桃红饮（桃仁、红花、川芎、当归尾、威灵仙、麝香）合独活寄生汤（独活、桑寄生、杜仲、牛膝、细辛、秦艽、茯苓、桂心、防风、川芎、人参、甘草、当归、芍药、干地黄）加减。左归丸加减（A错）为眩晕肾精不足证的方剂应用。眩晕肾精不足证：【方剂应用】基础方剂为左归丸（熟地黄、山药、山茱萸、菟丝子、枸杞子、川牛膝、鹿角胶、龟板胶）加减。舒筋活血丸加减（E错）为跌打损伤气滞血瘀证的方法及应用。跌打损伤气滞血瘀证：【方剂应用】基础方剂为：初期用顺气活血汤（苏梗、厚朴、枳壳、砂仁、赤芍、当归尾、红花、木香、桃仁、苏木、香附）加减；后期予疏风养血汤（荆芥、羌活、防风、当归、川芎、白芍、秦艽、薄荷、红花、天花粉）或舒筋活血汤（荆芥、羌活、防风、当归、独活、续断、青皮、牛膝、红花、五加皮、杜仲、枳壳）加减。方剂应用为养血荣筋丸加减（D错）的病证，2022年考试指南未明确说明。